主要用于控制症状的抗疟药
A. 卡铂
B. 氯喹
C. 利福平
D. 青霉素
E. 红霉素

正确答案：B。氯喹

解析：主要用于控制症状的抗疟药包括氯喹、青蒿素等。掌握“氯喹、青蒿素、伯氨喹及乙胺嘧啶”知识点。